泪液在泪道内流通的途径为
A. 泪点→泪囊→泪小管→鼻泪管→鼻腔
B. 泪囊→泪小管→泪点→鼻泪管→鼻腔
C. 泪点→泪小管→泪囊→鼻泪管→鼻腔
D. 泪囊→泪点→泪小管→鼻泪管→鼻腔
E. 泪小管→泪点→泪囊→鼻泪管→鼻腔

正确答案：C。泪点→泪小管→泪囊→鼻泪管→鼻腔

解析：泪液在泪道内流通的途径为泪点→泪小管→泪囊→鼻泪管→鼻腔（C对）。